Ⅲ型超敏反应的发生机制说法正确的是
A. 血液中的可溶性抗原与IgD或IgM结合可形成中等大小的免疫复合物
B. 血液中的可溶性抗原与IgG或IgD结合可形成中等大小的免疫复合物
C. 血液中的可溶性抗原与IgG或IgM结合可形成中等大小的免疫复合物
D. 血液中的不可溶性抗原与IgG或IgM结合可形成中等大小的免疫复合物
E. 血液中的不可溶性抗原与IgG或IgD结合可形成中等大小的免疫复合物

正确答案：C。血液中的可溶性抗原与IgG或IgM结合可形成中等大小的免疫复合物

解析：Ⅲ型超敏反应的发生机制：血液中的可溶性抗原与IgG或IgM结合可形成中等大小的免疫复合物。掌握“Ⅱ型、Ⅲ型、Ⅳ型超敏反应”知识点。